称为众方之祖的医学典籍是
A. 《伤寒论》
B. 《温疫论》
C. 《千金翼方》
D. 《黄帝内经》
E. 《肘后备急方》

正确答案：A。《伤寒论》

解析：本题考查的是主要医学典籍。称为众方之祖的医学典籍是《伤寒论》（A对）。《伤寒论》：简称《伤寒》，汉·张机（字仲景）撰著。全书10卷，共22篇。书中总结了先秦两汉时代的医学成就，继承与发展了《内经》的基本理论，创造性地将医学理论与临床实践紧密结合。该书载方113首，配伍严谨，体现了君臣佐使的组方原则，并包含汗、吐、下、和、温、清等法，具有广泛的适用性。剂型有汤剂、散剂、丸剂、栓剂等，有很高的临床实用价值，后世称其为“众方之祖”。所用药物约96味，有植物药、动物药、矿物药、加工品等。炮制方法有火制、水制、水火同制等，且注重煎服方法，具有很高的科学价值。并创药物与针灸并用之法，对临床具有指导意义。《温疫论》（B错）：明·吴又可撰于公元1642年。全书共2卷，补遗1卷。该书为中医史上第一部论温疫的专著，在温病温疫的病因、病机和证治方面突破了《伤寒论》的原有框架，创立了辨治温疫温病的新理论，对后世温病医家有很大启发和影响。《千金翼方》（C错）：唐•孙思邈撰著于公元682年。该书是《千金要方》的续编，与《千金要方》相辅相成。全书30卷。该书与《千金要方》对后世中医学发展具有重要的影响。《黄帝内经》（D错）：又称《内经》，是最早的一部中医典籍，也是中医学最重要的经典著作。《黄帝内经》分《黄帝内经素问》和《灵枢经》两部分。《黄帝内经素问》，简称《素问》，原书9卷，计81篇。大约历经春秋战国至秦汉陆续汇集而成。作为现存最早、最为系统的医学经典著作，全面总结了秦汉以前古代医学的临床经验和理论。充分体现了人与自然统一的整体运动观念，确立了因时、因地、因人制宜的辨证施治原则，形成了独具特色的中医学理论体系，并为其发展奠定了坚定的基础。《灵枢经》，又称《黄帝内经灵枢》，简称《灵枢》。原书九卷，81篇。约成书于春秋战国至秦汉时期。侧重于经络理论和针刺方法，是全面系统总结我国汉代以前中医学理论、经络学说和针刺技术的经典著作，为后世医学尤其是针灸学的发展奠定了坚定的基础。因其详于经络腧穴针灸刺法，故又有《针经》之称。《肘后备急方》（E错）：又名《肘后救卒方》，简称《肘后方》，东晋·葛洪撰，成书年代不详。全书共8卷，73篇，第1～72篇为内、外、五官、妇、儿各科急症的治疗；第73篇为治疗牛、马等六畜疾病，属兽医学内容。此书属急症手册性质。全书总结了东晋以前的中医急症治疗成就，许多记载具有很高的医学史料价值，在急症的病因、病理上时有发明。